中阳衰微，胃有寒湿者忌用的药物是
A. 太子参
B. 西洋参
C. 益智仁
D. 菟丝子
E. 山药

正确答案：B。西洋参

解析：该题考查西洋参药物的使用注意。中阳衰微，胃有寒湿者忌用药性寒凉的药物。而西洋参药性寒凉，能伤湿碍中，所以中阳衰微，胃有寒湿者忌用（B对）。太子参药性平和，多入复方作病后调补之药（A错）。益智仁具有温脾开胃摄唾的功效，可用于治疗脾胃虚寒证（C错）。菟丝子辛以润燥，甘以补虚，为平补阴阳之品（D错）。山药性味甘平，能补脾益气，滋养脾阴，可用于治疗脾胃虚寒者（E错）。